关于β受体阻滞药的禁忌证，错误的是
A. 严重心功能不全
B. 支气管哮喘
C. 高血压
D. 重度房室传导阻滞
E. 窦性心动过缓

正确答案：C。高血压

解析：β受体阻滞药的禁忌证：严重心功能不全（A对）、窦性心动过缓（E对）、重度房室传导阻滞（D对）和支气管哮喘（B对）。β受体阻滞药是治疗高血压的基础药物（C错，为本题正确答案）。